应用阿托品治疗各种内脏绞痛时引起的口干、心悸等属于
A. 变态反应
B. 后遗效应
C. 毒性反应
D. 特异质反应
E. 副作用

正确答案：E。副作用

解析：本题考查药品的不良反应。应用阿托品治疗各种内脏绞痛时引起的口干、心悸属于副作用（E对）。副作用是指在药物按正常用法用量使用时，出现的与治疗目的无关的不适反应。如阿托品用于解除胃肠痉挛时，会引起口干、心悸、便秘等副作用。变态反应（A错）是指机体受药物刺激所发生异常的免疫反应，引起机体生理功能障碍或组织损伤，又称为过敏反应。后遗效应（B错）是指在停药后血药浓度已降低至最低有效浓度以下时仍残留的药理效应。毒性作用（C错）是指在药物剂量过大或体内蓄积过多时发生的危害机体的反应。特异质反应（D错）是指少数特异体质患者对某些药物反应异常敏感。